属于实验流行病学
A. 现患调查
B. 病例对照研究
C. 观察某种药物治疗的疗效
D. 将调查数据建立流行病学数学模型
E. 基础实验室检查

正确答案：C。观察某种药物治疗的疗效

解析：本题考查实验流行病学的作用，实验流行病学主要用于评价各种干预措施的效果，可用来观察药物治疗的疗效（C对）。现患调查（A错）属于描述性研究。病例对照研究（B错）属于分析流行病学。建立流行病学数学模型（D错）属于数理法。基础实验室检查（E错）不属于流行病学研究方法。